决定子代体质因素的先天关键因素
A. 父母的体质因素
B. 父母的年龄
C. 血缘关系近远
D. 妊娠因素

正确答案：A。父母的体质因素

解析：本题考查影响体质的因素。决定子代体质因素的先天关键因素父母的体质因素（A对）。体质禀受于先天，得养于后天，一个人现在的体质是过去形成的，而现在又在过去的基础上形成着将来的体质，故受到机体内外环境多种因素的共同影响。体质特征取决于脏腑经络气血的强弱盛衰，因此凡能影响脏腑经络、精气血津液功能活动的因素，均可影响体质。1.先天禀赋：先天禀赋是体质形成的基础，是人体体质强弱的前提条件。故《灵枢·决气》说：“两神相搏，合而成形。”张介宾称之为“形体之基”。因此父母生殖之精的盈亏盛衰和体质特征决定着子代禀赋的厚薄强弱，影响其体质，父母体内阴阳的偏颇和功能活动的差异，会影响子代也有同样的倾向性。2.年龄因素（B错）：体质是一个随着个体发育的不同阶段而不断演变的生命过程，某个阶段的体质特点与另一个阶段的体质特点不同。3.性别差异：体质上存在着性别差异。4.饮食因素：长期的饮食习惯和固定的膳食品种质量会影响体质。5.劳逸所伤：劳逸适度有利于人体的身心健康，保持良好的体质。6.情志因素：七情的变化，通过影响脏腑精气的盛衰变化而影响人的体质。7.地理因素：不同地域人群的饮食结构、居住条件、生活方式、社会民俗等也影响着人的形态结构、生理功能和心理行为特征的形成和发展。8.疾病针药及其他因素：疾病是促使体质改变的一个重要因素。总之，体质禀赋于先天，受制于后天。先后天多种因素构成影响体质的内外环境，在先后天因素的共同作用下，不同个体形成了各异的体质特征。